有关热原的性质的正确表述有
A. 耐热性
B. 可滤过性
C. 不挥发性
D. 水不溶性
E. 不耐酸碱性

正确答案：A、B、C、E。耐热性；可滤过性；不挥发性；不耐酸碱性

解析：本题考查热原的性质。热原的性质：（1）水溶性（D错）；（2）不挥发性（C对）；（3）耐热性（A对）；（4）过滤性（B对）；（5）其他性质。热原能被强酸、强碱、强氧化剂如高锰酸钾、过氧化氢以及超声波破坏（E对）。热原在水溶液中带有电荷，也可被某些离子交换树脂所吸附。